乙肝抗原抗体系统中唯一对乙肝起有效保护作用的是
A. HBsAg
B. HBsAb
C. HBeAg
D. HBeAb
E. HBcAb

正确答案：B。HBsAb

解析：本题考查乙肝抗原抗体系统。乙肝抗原抗体系统中唯一对乙肝起有效保护作用的是HBsAb（B对ACDE错）。HBsAb又称乙型肝炎表面抗体，是机体受HBsAg刺激而产生的相应抗体，它可以与HBsAg相结合，在体内其他免疫系统共同作用下清除病毒，以保护机体不再受HBV的感染。